下列关于三角嵴的说法，正确的是
A. 是前牙舌面窝的近远中边缘的长条形釉质隆起
B. 在唇、颊面上的长形线状隆起
C. （牙合）面两牙尖三角嵴相连形成嵴
D. 后牙（牙合）面边缘的长条形釉质隆起
E. 从后牙牙尖顶端伸向（牙合）面中央的细长形釉质隆起

正确答案：E。从后牙牙尖顶端伸向（牙合）面中央的细长形釉质隆起

解析：三角嵴：是从后牙牙尖顶端伸向（牙合）面中央的细长形釉质隆起。掌握“牙的萌出、更替及牙体解剖名词、标志”知识点。